口服给药受首过效应影响，生物利用度仅50%的药物是
A. 盐酸哌替啶
B. 盐酸布桂嗪
C. 盐酸美沙酮
D. 枸橼酸芬太尼
E. 盐酸苯噻啶

正确答案：A。盐酸哌替啶